热极津枯可见
A. 花剥而兼腻苔
B. 黄腻苔
C. 薄白苔
D. 黑而燥裂苔
E. 黑而滑润苔

正确答案：D。黑而燥裂苔

解析：舌焦黑干燥，舌质干裂起刺者，无论外感或内伤，均为热极津枯之征（D对）。舌苔部分剥落，未剥脱处仍有腻苔者，多为正气亏虚，痰浊未化，病情较为复杂（A错）。黄苔而质腻者，主湿热或痰热内蕴，或为食积化腐（B错）。舌苔薄白而均匀，或中部稍厚，干湿适中，为正常舌苔，提示胃有生发之气。若在病中，说明病情轻浅，未伤胃气（C错）。在寒湿病中出现灰黑苔，多由白苔转化而成，其舌苔灰黑必湿润多津（E错）。